心源性休克发病的中心环节是：
A. 回心血量减少
B. 心率过快
C. 心输出量降低
D. 心肌收缩力减弱
E. 心律失常

正确答案：C。心输出量降低

解析：心源性休克是指由于心脏泵血功能障碍，心输出量降低（C对ABDE错），使有效循环血量和微循环灌流量显著下降所引起的休克。